哪一对不含有感觉纤维
A. 三叉神经
B. 面神经
C. 舌下神经
D. 动眼神经
E. 迷走神经

正确答案：D。动眼神经

解析：动眼神经（D对）含一般躯体运动纤维及一般内脏运动（副交感）纤维，不含有感觉纤维。三叉神经（A错）含一般躯体感觉纤维和特殊内脏运动纤维。面神经（B错）含特殊内脏运动纤维、一般内脏运动纤维、特殊内脏感觉纤维和一般躯体感觉纤维。舌下神经（C错）含一般躯体运动纤维。迷走神经（E错）含一般内脏运动纤维、一般内脏感觉纤维、特殊内脏运动纤维、一般躯体感觉纤维。